易于早期发现和切除的肿瘤
A. 成釉细胞纤维瘤
B. 角化成釉细胞瘤
C. 牙源性腺样瘤
D. 牙源性粘液瘤
E. 外周型成釉细胞瘤

正确答案：E。外周型成釉细胞瘤

解析：本题考查外周型成釉细胞瘤的特点。外周型成釉细胞瘤（E对）是易于早期发现和切除的肿瘤。外周型成釉细胞瘤生长局限于牙龈，术后无复发。角化成釉细胞瘤（B错）是一种罕见的组织学亚型，肿瘤内出现广泛角化，镜下肿瘤由多个充满角化物的微小囊肿构成，衬里上皮以不全角化为主，并伴有乳头状增生，又称乳头状角化成釉细胞瘤。牙源性腺样瘤（C错）是一种包膜完整、生长局限的良性肿瘤，刮治后一般不复发，镜下见肿瘤上皮可形成不同结构，肿瘤内有时还可见发育不良的牙本质或骨样牙本质。成釉细胞纤维瘤（A错）是一种较少见的牙源性肿瘤，主要特征是牙源性上皮和间叶组织同时增殖，但不伴牙本质和牙釉质形成，是一种真性混合性牙源性肿瘤。牙源性粘液瘤（D错）手术不易完全切除，术后易复发，但一般不发生转移，是一种良性但有局部浸润的肿瘤。